下列哪一种不属于有机磷农药中毒的表现
A. 呼吸道分泌物增加，严重时发生肺水肿
B. 全身紧束感、恶心、呕吐、食欲缺乏
C. 头晕、头痛、语言不清、神经衰弱综合征
D. 症状消失后2~3周个别患者出现周围神经病
E. 肝功能严重受损

正确答案：E。肝功能严重受损